有关心脏沟的描述正确的是
A. 近心底处有一完整的环形的冠状沟
B. 冠状沟将上方的心房与下方的心室分开
C. 前室间沟由冠状沟向下至心尖
D. 后室间沟在心的膈面、由冠状沟向下至心尖
E. 前、后室间沟在心尖的右侧汇合处称心尖切迹

正确答案：E。前、后室间沟在心尖的右侧汇合处称心尖切迹

解析：冠状沟近似环形（A错）。是右上方的心房与左下方的心室（B错）表面的分界。前室间沟和后室间沟分别在心室的胸肋面和隔面（D错），从冠状沟走向心尖的右侧（C错）。前、后室间沟在心尖的右侧汇合处称心尖切迹（E对）。